急性牙髓炎主要病理变化是
A. 淋巴细胞浸润
B. 浆细胞浸润
C. 肉芽组织形成
D. 巨噬细胞浸润
E. 中性粒细胞浸润

正确答案：E。中性粒细胞浸润

解析：本题考查急性牙髓炎的病理变化。急性牙髓炎主要病理变化是中性粒细胞浸润（E对）。急性牙髓炎的病理变化：早期病变局限在受刺激部位相对应的牙髓，如龋损下方，牙髓血管扩张充血，血管通透性增加，液体渗出，组织水肿，沿血管壁周围有纤维蛋白渗出，这时称急性浆液性牙髓炎。随着炎症加重，血流速度减慢，细胞沿血管壁排列，成牙本质细胞变性坏死，受损的组织、细胞和炎细胞释放大量炎性介质和细胞因子，如组胺、5-羟色胺、白细胞介素、肿瘤坏死因子、白三烯、前列腺素转化生长因子等，这些细胞因子和炎症介质进一步增加血管的通透性，趋化更多的中性粒细胞向炎症中心集中。单核细胞、淋巴细胞、浆细胞也浸润到病变中。中性粒细胞、巨噬细胞等在杀灭细菌的同时释放溶酶体酶和蛋白水解酶，使局部组织液化坏死，形成脓肿。早期脓肿局限，脓腔内有密集的中性粒细胞浸润，其余牙髓水肿伴炎细胞浸润。这时若得以及时治疗，还可以保存部分牙髓，否则，炎症迅速向周围扩散，中性粒细胞广泛浸润至整个牙髓组织，形成多处小脓肿，此时，若炎性渗出未得到及时引流，髓腔压力极度增加，最终使整个牙髓液化坏死，此时称为急性化脓性牙髓炎。